临床心理评估是心理治疗和心理咨询的
A. 前提
B. 依据
C. 效果判定
D. 效果评价
E. 以上都是

正确答案：E。以上都是

解析：心理评估在医学心理学中的作用是非常重要的，医学心理学的一个大的领域是临床心理学，而临床心理学的两个基本任务是：一是临床心理评估，另一个是心理干预（如心理治疗或心理咨询）。显然心理评估是心理干预的重要前提和依据，同时心理评估还可对心理干预的效果作出判定。掌握“常用的心理测验及临床评定测量表”知识点。